下列关于疫苗上市许可持有人的说法，错误的是
A. 应当采用信息化手段如实记录生产、检验过程中形成的所有数据
B. 应当承担药品上市许可持有人主体责任，不得委托生产
C. 法定代表人、主要负责人应当具有良好信用记录
D. 应当按照规定对疫苗生产全过程和疫苗质量进行审核、检验

正确答案：B。应当承担药品上市许可持有人主体责任，不得委托生产

解析：本题考查疫苗生产管理制度。国家对疫苗生产实行严格准入制度。从事疫苗生产活动，应当经省级以上人民政府药品监督管理部门批准，取得药品生产许可证。从事疫苗生产活动，除符合《药品管理法》规定的从事药品生产活动的条件外，还应当具备下列条件：①具备适度规模和足够的产能储备；②具有保证生物安全的制度和设施、设备；③符合疾病预防、控制需要。疫苗上市许可持有人应当具备疫苗生产能力；超出疫苗生产能力确需委托生产的（B错，为本题正确答案），应当经国务院药品监督管理部门批准。接受委托生产的，应当遵守本法规定和国家有关规定，保证疫苗质量。疫苗上市许可持有人应当建立完整的生产质量管理体系，持续加强偏差管理，采用信息化手段如实记录生产、检验过程中形成的所有数据（A对），确保生产全过程持续符合法定要求。疫苗上市许可持有人的法定代表人、主要负责人应当具有良好的信用记录（C对），生产管理负责人、质量管理负责人、质量受权人等关键岗位人员应当具有相关专业背景和从业经历。疫苗上市许可持有人应当按照规定对疫苗生产全过程和疫苗质量进行审核、检验（D对）。